参与构成蛋白质合成场所的RNA是
A. 信使RNA
B. 核糖体RNA
C. 核内小RNA
D. 催化性RNA
E. 转运RNA

正确答案：B。核糖体RNA

解析：参与构成蛋白质合成场所的RNA是核糖体RNA（B对）。信使RNA （mRNA ）是蛋白质生物合成的模板（A错）。转运RNA（tRNA）是蛋白质合成中氨基酸的载体（E错）。